有抗生素摄入史，且乳牙与恒牙均可产生相关的牙齿变色的疾病为
A. 氟斑牙
B. 四环素牙
C. 特纳牙
D. 遗传性乳光牙本质
E. 哈钦森牙

正确答案：B。四环素牙

解析：四环素牙是一种在牙齿发育期间全身性应用四环素而造成的牙齿内源性染色。由于其可以通过胎盘屏障，故乳牙和恒牙均可造成染色病损。掌握“四环素牙”知识点。